吗啡不会产生下述的
A. 呼吸抑制
B. 止咳作用
C. 体位性低血压
D. 腹泻稀便症状
E. 支气管平滑肌收缩

正确答案：D。腹泻稀便症状